网织红细胞减少，见于
A. 巨幼细胞性贫血
B. 再生障碍性贫血
C. 溶血性贫血
D. 缺铁性贫血
E. 脾功能亢进性贫血

正确答案：B。再生障碍性贫血

解析：再生障碍性贫血是由多种病因引起的骨髓造血功能衰竭，出现以全血细胞减少为主要表现的一种综合征，贫血一般呈正细胞正色素性，网织红细胞明显减少（B对）。巨幼细胞性贫血血象特点是呈大细胞性贫血，网织红细胞可正常（A错）。溶血性贫血是由红细胞的破坏加速，增多，超过造血补偿能力时所发生的一类贫血。溶血性贫血时，骨髓幼红细胞代偿性增生，网织红细胞增多，一般可达5%～20%（C错）。缺铁性贫血轻时可呈正细胞正色素性贫血，典型者呈小细胞低色素性贫血，网织红细胞计数计数大多正常或轻度升高（D错）。脾功能亢进性贫血主要破坏成熟的红细胞、血小板，网织红细胞计数多正常（E错）。